内服涌吐热痰，研末吹鼻引去湿热的药是
A. 常山
B. 瓜蒂
C. 甘松
D. 铅丹
E. 砒石

正确答案：B。瓜蒂

解析：本题考查的是瓜蒂的功效。内服涌吐热痰，研末吹鼻引去湿热的药是瓜蒂（B对）。瓜蒂：【功效】内服涌吐热痰、宿食；外用研末吹鼻，引去湿热。常山（A错）：【功效】涌吐痰饮，截疟。甘松（C错）：【功效】行气止痛，开郁醒脾。铅丹（D错）：【功效】外用拔毒止痒，敛疮生肌；内服坠痰镇惊，攻毒截疟。砒石（E错）：【功效】外用蚀疮去腐；内服劫痰平喘，截疟。